下列哪种疾病属介水传染病
A. 克汀病
B. 水俣病
C. 甲型肝炎
D. 氟斑牙
E. 地方性甲状腺肿

正确答案：C。甲型肝炎

解析：本题考查介水传染病。介水传染病是指通过饮用或接触病原体污染的水而传播的疾病。如甲型肝炎（C对）就是通过饮用或接触甲型肝炎病毒污染的水而传播的疾病。克汀病（A错）、氟斑牙（D错）、地方性甲状腺肿（E错）属于生物地球化学性疾病。水俣病（B错）是慢性甲基汞中毒的典型案例，属于环境污染性疾病。